中致吐性化疗药物所引起的恶心、呕吐，宜选用的止吐治疗方案是
A. 化疗前联合使用昂丹司琼和地塞米松，化疗结束后给予2天的地塞米松或昂丹司琼
B. 化疗前后联合使用地塞米松和甲氧氯普胺
C. 化疗前联合使用昂丹司琼、地塞米松和阿瑞吡坦，化疗结束后给予2天的阿瑞吡坦和2～3天的地塞米松
D. 化疗前使用昂丹司琼，化疗后不需要继续使用止吐药
E. 化疗前使用阿瑞吡坦，化疗后需要继续使用止吐药

正确答案：A。化疗前联合使用昂丹司琼和地塞米松，化疗结束后给予2天的地塞米松或昂丹司琼

解析：本题考查止吐药的选择。化疗前联合使用昂丹司琼和地塞米松，化疗结束后给予2天的地塞米松或昂丹司琼（A对）为中致吐性化疗药物所引起的恶心、呕吐，宜选用的止吐治疗方案；高致吐性化疗药物所引起的恶心、呕吐，宜选用的止吐治疗方案是化疗前联合使用昂丹司琼、地塞米松和阿瑞吡坦，化疗结束后给予2天的阿瑞吡坦和2～3天的地塞米松（C错）；低致吐性化疗药所引起恶心呕吐，宜选用的止吐治疗方案是化疗前使用昂丹司琼，化疗后不需要继续使用止吐药（D错）。